脓毒症早期典型的临床表现是
A. 呼吸困难
B. 休克
C. 少尿
D. 昏迷
E. 寒战、高热

正确答案：E。寒战、高热

解析：脓毒症是指因病原菌因素引起的全身性炎症反应。常在原发感染灶的基础上发展而来，起病急，发展迅速，以骤起的寒战、高热为首发，即早期典型临床表现（E对）。继而出现头痛恶心等，随着病情的进一步加重，出现少尿（C错），昏迷（D错），呼吸困难（A错）以及休克（B错）等症状（作为全身性的炎症反应，寒战、高热一般均会出现，属典型症状，其他表现不是）。